下列各项，不支持流行性脑脊髓膜炎诊断的脑脊液检查是
A. 外观混浊呈脓性
B. 蛋白质含量高
C. 细胞数<0.5×10⁹/L，以单核细胞为主
D. 糖含量明显减少
E. 氯化物含量减少

正确答案：C。细胞数<0.5×10⁹/L，以单核细胞为主

解析：流行性脑脊髓膜炎即化脓性脑膜炎，是由脑膜炎双球菌引起的，脑脊液检查包括：①外观混浊呈脓性（A对）。②蛋白质含量高（B对）。③白细胞总数常超过1×10⁹/L，以中性粒细胞为主。④糖含量明显减少（D对）。⑤氯化物含量减少（E对）。细胞数<0.5×10⁹/L，以单核细胞为主（C错，为本题正确答案）可见于结核性脑膜炎。